以下有关窝洞抗力型的描述中，不恰当的是
A. 后牙洞深以到达釉质牙本质界下0.2～0.5mm为宜
B. 盒形洞形，底平，壁直
C. 复面洞阶梯的龈壁应与牙长轴平行
D. 去除薄壁弱尖
E. 去除所有无基釉

正确答案：C。复面洞阶梯的龈壁应与牙长轴平行

解析：邻面的龈壁应与牙长轴垂直，位于接触点根方的健康牙体组织上，并要有一定的深度，不得小于1mm，这样邻面龈壁才能承担（牙合）力。掌握“银汞充填窝洞的概念”知识点。